二型观测线是
A. 基牙的远、近缺隙侧均有明显的倒凹
B. 基牙向缺隙方向倾斜时所画出的观测线
C. 基牙向缺隙相反方向倾斜时所画出的观测线
D. 基牙向颊侧倾斜时所形成的观测线
E. 基牙向舌侧倾斜时所形成的观测线

正确答案：B。基牙向缺隙方向倾斜时所画出的观测线

解析：本题考查局部义齿类型，肯氏分类及模型观测。二型观测线：为基牙向缺隙方向倾斜时所画出的观测线（B对）。此线在近缺隙侧距（牙合）面近，而远缺隙侧距（牙合）面远，说明近缺隙侧的倒凹大，远缺隙侧的倒凹小。